典型二尖瓣面容的特点是
A. 面色晦暗，双颊紫红，口唇发绀
B. 表情淡漠，反应迟钝，呈无欲状态
C. 眼裂增大，眼球突出，目光闪烁，呈惊恐貌
D. 面色苍白，颜面浮肿
E. 面色潮红，兴奋不安，口唇干燥

正确答案：A。面色晦暗，双颊紫红，口唇发绀

解析：二尖瓣面容是双颊紫红，口唇轻度发绀，面色晦暗。见于风湿性心瓣膜病二尖瓣狭窄（A对）。伤寒面容是表情淡漠，反应迟钝呈无欲状态。见于伤寒、脑脊髓膜炎、脑炎等高热衰竭者（B错）。甲状腺功能亢进面容是眼裂增大，眼球突出，目光炯炯有神，兴奋不安，烦躁易怒，呈惊恐貌。见于甲状腺功能亢进症（C错）。黏液性水肿面容是面色苍白，颜面浮肿，睑厚面宽，目光呆滞，反应迟钝，眉毛、头发稀疏，舌胖色淡。见于甲状腺功能减退症（D错）。急性病容是面色潮红，兴奋不安，鼻翼扇动，口唇干燥疱疹，表情痛苦。多见于干肺炎链球菌肺炎，疟疾、流行性脑脊髓膜炎等（E错）。